关于单室模型静脉滴注给药的说法，正确的是
A. 血药浓度达稳态后，加快滴注速率，血药浓度又会重新上升并趋于稳定
B. 滴注开始时，药物的消除速率大于给药速率
C. 滴注速度越大，达到稳态血药浓度的时间越短
D. 达到稳态血药浓度的75%所需要的滴注时间是3个生物半衰期
E. 可通过减慢滴注速率的方式降低药物的消除速率

正确答案：A。血药浓度达稳态后，加快滴注速率，血药浓度又会重新上升并趋于稳定

解析：本题考查单室模型。静脉滴注期间，血药浓度一开始逐渐上升，当滴注时间充分大，血药浓度趋近于恒定水平，此时的血药浓度值称为稳态血药浓度，稳态血药浓度的大小与静滴速度构成正比，当静注速度增加，稳态血药浓度也会增加（A对）。